继发性腹膜炎的腹痛特点是
A. 阵发性全腹绞痛
B. 逐渐加重的阵发性腹痛
C. 剧烈、持续性全腹痛，原发部位显著
D. 高热后全腹痛
E. 腹痛伴肠鸣音亢进

正确答案：C。剧烈、持续性全腹痛，原发部位显著

解析：继发性腹膜炎常为腹腔空腔脏器穿孔、外伤引起的腹壁或内脏破裂所致。空腔脏器内容物（如胃液、胆汁）、血液等漏入腹腔，持续刺激腹膜，可引起剧烈的、难以忍受的持续性全腹痛，疼痛先从原发病变部位开始，后迅速延及全腹，以原发部位显著（C对）。阵发性绞痛（A错）多见于胆结石或泌尿系结石。逐渐加重的阵发性腹痛（B错）、腹痛伴肠鸣音亢进（E错）见于机械性肠梗阻。高热后全腹痛（D错）为原发性腹膜炎的腹痛特点。